反相色谱填料常选择的键合烃基有
A. 羟基
B. 硝基
C. 辛基
D. 十八烷基
E. 羧基

正确答案：C、D。辛基；十八烷基

解析：本题考查的是反相色谱。反相色谱填料常选择的键合烃基有辛基（C对）与十八烷基（D对）。反相色谱：当分离脂溶性化合物，如高级脂肪酸、油脂、游离甾体等时，则两相可以颠倒，固定相可用石蜡油，而流动相则用水或甲醇等强极性溶剂，故称之为反相分配色谱。常用反相硅胶薄层及柱色谱的填料系将普通硅胶经下列方式进行化学修饰，键合上长度不同的烃基（R）、形成亲油表面而成。根据烃基（-R）长度为乙基（-C₂H₅）还是辛基（-C₈H₁₇）或十八烷基（-C₁₈H₃₇），分别命名为RP-2、RP-8及RP-18。三者亲脂性强弱顺序如下：RP-18＞RP-8＞RP-2。羟基（A错）、硝基（B错）、羧基（E错）不属于反相硅胶色谱的填料系。